兼有阻滞钾通道和β受体拮抗作用，临床用于治疗各种室性心律失常，持续性及非持续性室性心动过速，心房扑动，心房颤动的治疗药物是
A. 胺碘酮
B. 维拉帕米
C. 索他洛尔
D. 普罗帕酮
E. 美西律

正确答案：C。索他洛尔

解析：本题考查索他洛尔的药理作用与临床应用。索他洛尔（C对）具有阻滞钾离子通道的作用，同时兼有β受体阻断作用，临床用于治疗各种室性心律失常，持续性及非持续性室性心动过速，心房扑动，心房颤动。